兴奋β₂受体，解除支气管痉挛的药物是
A. 二丙酸倍氯米松
B. 可待因
C. 沙丁胺醇
D. 氨茶碱
E. 色甘酸钠

正确答案：C。沙丁胺醇

解析：本题考查沙丁胺醇。兴奋β₂受体，解除支气管痉挛的药物是沙丁胺醇（C对）。沙丁胺醇是常用的选择性的短效β₂受体激动剂，支气管扩张作用明显，对心脏β₁受体激动作用较弱。临床上用于缓解支气管哮喘、哮喘型支气管炎和肺气肿患者的支气管痉挛性急性症状。二丙酸倍氯米松（A错）为吸入型糖皮质激素，通过抑制气道炎症反应，达到长期防止哮喘发作的效果。可待因（B错）为中枢性镇咳药。氨茶碱（D错）为非特异性磷酸二酯酶（PDE）抑制剂，主要通过抑制PDE₃、PDE₄和PDE₅，使细胞内cAMP和cGMP水平升高，松弛支气管平滑肌。色甘酸钠（E错）为肥大细胞膜稳定剂，临床主要用于预防哮喘发作。